机械性肠梗阻与动力性肠梗阻的主要区别在于早期
A. 有无腹痛、腹胀及肛门停止排便、排气
B. 有无绞痛、腹胀和肠鸣音变化
C. 呕吐是否剧烈且频繁
D. 有无休克
E. 有无酸碱失衡电解质紊乱

正确答案：B。有无绞痛、腹胀和肠鸣音变化

解析：机械性肠梗阻指由于机械性因素引起肠腔狭小或不通，使肠内容物不能通过所致的肠梗阻，早期由于梗阻部位以上肠管内容物不能向下运行，肠管剧烈蠕动，患者可出现腹部绞痛，伴高亢的肠鸣音；腹胀发生在腹痛之后，但高位机械性肠梗阻早期腹胀可不显著。动力性肠梗阻指由于神经抑制或毒素刺激以致肠壁肌运动紊乱所致的肠梗阻，可分为麻痹性和痉挛性两类，麻痹性肠梗阻较为常见，故临床所说的动力性肠梗阻主要指麻痹性肠梗阻。麻痹性肠梗阻的肠壁肌呈瘫痪状态，没有收缩蠕动，因此无腹部绞痛，听诊时肠鸣音减弱或消失，腹胀出现早且显著，可遍及全腹。因此，机械性肠梗阻与动力性肠梗阻的主要区别在于早期有无绞痛、腹胀和肠鸣音变化（B对）。各种原因引起的肠梗阻均可出现腹痛、腹胀、停止自肛门排气排便及水、电解质紊乱和酸碱失衡等表现，严重者可出现休克（ADE错）。呕吐是否剧烈且频繁（C错）是高位肠梗阻与低位肠梗阻的主要区别。